下列关于卫生服务需求不正确的选项是
A. 需求与需要的实质是一致的
B. 需求可以由需要转化而来
C. 需求与消费者的支付能力成正比
D. 需求与消费者的购买意向成正比
E. 有些需求是不必要的

正确答案：A。需求与需要的实质是一致的

解析：卫生服务需求是在一定时期内和一定价格水平上，人们愿意而且有能力消费的卫生服务量，而卫生服务需要是依据人们的实际健康状况与“理想健康状态”之间存在差距而提出的对预防、保健、医疗、康复等服务的客观要求，需要是需求的基础，但需求并不就是需要（A错，为本题正确答案）。卫生服务需求分为有需要转化而来的需求和没有需要的需求，后者包括一些不必要的需求（BE对）。一般情况下，消费者支付能力越强（C对），购买意向越强（D对），卫生服务量也越多。